下列关于失眠药物治疗策略的说法，正确的是
A. 原发性失眠在非药物治疗无效时首选苯二氮䓬类抗失眠药
B. 失眠继发于或伴发于其它疾病时，应同时治疗原发或伴发疾病
C. 药物治疗开始后应及时开展血药浓度监测
D. 焦虑症患者存在失眠时，以抗失眠药物为主
E. 对于长期应用镇静催眠药物的慢性失眠患者，提倡药物连续治疗

正确答案：B。失眠继发于或伴发于其它疾病时，应同时治疗原发或伴发疾病

解析：本题考查抗失眠药的使用。失眠继发于或伴发于其它疾病时，应同时治疗原发或伴发疾病（B对）。原发性失眠首选短效非苯二氮䓬类药物（A错）。药物治疗开始后应监测并评估患者的治疗反应（C错）。焦虑症患者存在失眠时，以抗焦虑药物为主（D错）。对于长期应用镇静催眠药物的慢性失眠患者，建议采用间歇治疗或按需治疗的服药方式（E错）。